男，62岁。上腹胀伴食欲下降4年。查体：T36.5℃，P80次/分，R18次/分，BP130/80mnHg。双肺呼吸音清，未闻及干湿性啰音，心律齐，腹软，无压痛。胃镜检查：胃粘膜菲薄，可见血管显露。血常规提示大细胞性贫血，血抗壁细胞抗体阳性。最可能的诊断是
A. 慢性萎缩性胃体炎
B. 慢性淋巴细胞性胃炎
C. 消化性溃疡
D. 慢性浅表性胃炎
E. 慢性萎缩性胃窦炎

正确答案：A。慢性萎缩性胃体炎

解析：男，62岁。上腹胀伴食欲下降4年。查体：T36.5℃，P80次/分，R18次/分，BP130/80mnHg。双肺呼吸音清，未闻及干湿性啰音，心律齐，腹软，无压痛。胃镜检查：胃粘膜菲薄，可见血管显露。血常规提示大细胞性贫血（慢性失血），血抗壁细胞抗体阳性。根据病史、临床表现、辅助检查，最可能的诊断是慢性萎缩性胃体炎（A对）。